肝的主要功能是分泌胆汁、参与代谢、贮存糖原、解毒及吞噬防御等，胚胎时期还有造血功能。肝呈楔形，分为上、下2面和前、后、左、右4缘。肝的上面隆凸，与膈相接，称膈面。膈面被镰状韧带分为大而厚的右叶和小而薄的左叶。肝下面凹凸不平，与腹腔脏器相邻，称脏面。脏面有一近似“H”形的沟，即２条矢状位的左、右纵沟和１条冠状位的横沟。肝的主要功能不包括下列哪项
A. 分泌胆汁
B. 参与物质代谢过程
C. 浓缩胆汁
D. 解毒、吞噬功能
E. 胚胎期有造血功能

正确答案：C。浓缩胆汁

解析：肝的主要功能有分泌胆汁(A对)，参与蛋白质、脂类等物质代谢过程(B对)，解毒和吞噬(D对)，胚胎时期造血(E对)，浓缩胆汁(C错，为本题正确答案)为胆囊的功能。